药学服务的效果体现在
A. 确认患者存在的或潜在的病症
B. 提高药物治疗的安全性、有效性、依从性和经济性
C. 有助于研究药物的作用机制
D. 协助规范医师的处方行为
E. 预测潜在的药品不良反应

正确答案：B。提高药物治疗的安全性、有效性、依从性和经济性

解析：本题考查药学服务。药学服务的效果体现在提高药物治疗的安全性、有效性、依从性和经济性（B对）。药师的科学、专业、严谨、耐心的回答可使患者获得用药指导，提高药物治疗的安全性、有效性、依从性和经济性，从而达到药学服务的效果。